男，68岁，近一年来自觉长距离行走时感气短，休息后可好转，否认呼吸系统疾病及心脏病史，查体未见明显异常。血常规及胸部X线片检查大致正常，为明确诊断，应首先进行的检查是
A. UCG
B. D－二聚体
C. 动脉血气分析
D. 胸部CT
E. 肺功能

正确答案：A。UCG

解析：老年患者，近一年来自觉长距离行走时感气短，休息后可好转（提示心力衰竭），既往无呼吸系统疾病及心脏病史，查体无异常，血常规及胸部X线片检查大致正常，根据该患者的临床症状、实验室检查，考虑最可能的诊断为慢性心力衰竭，为进一步确诊应首先进行的检查是超声心动图（UCG）（A对）。动脉血气分析（C错）主要用于呼吸衰竭的诊断及治疗。胸部CT（D错）主要用于肺部疾病的诊断，也可对心衰所致的肺水肿进行诊断，但目前该患者的X线片并没有明显异常，所以该患者目前不考虑肺水肿。通过肺功能（E错）检查可对受检者呼吸生理功能的基本状况作出质和量的评价，明确肺功能障碍的程度和类型。